下列有关H1V病原学特点，描述不正确的是
A. 有H1V-1H1V-2两型
B. 为RNA病毒
C. 主要侵犯CD⁸⁺T淋巴细胞
D. 属反转录病毒科
E. 对理化因素耐受性低

正确答案：C。主要侵犯CD⁸⁺T淋巴细胞

解析：HIV主要侵犯CD⁴⁺T淋巴细胞（C对）。根据HIV基因的差异，目前可将HIV分为HIV-1型和HIV-2型（A错）。HIV属于单链RNA病毒（B错），属于反转录病毒科（D错），慢病毒属中的人类慢病毒组。HIV在外界环境生存能力较弱，对物理化学因素耐受力较低。56℃30分钟可使其失去感染性，100℃20分钟可使其完全灭活。一般消毒剂如碘酊、过氧乙酸、戊二醛、次氯酸钠和75%酒精等均可将其灭活（E错）。